治疗风痧邪入气营证，应首选
A. 透疹凉解汤
B. 银翘散
C. 桑菊饮
D. 清营汤
E. 清胃解毒汤

正确答案：A。透疹凉解汤

解析：透疹凉解汤：清热解毒，凉营透疹，适用于风痧邪入气营证（A对）。银翘散（B错）疏风解表，清热透疹，适用于风痧邪犯肺卫证。